系统性红斑狼疮中具有该病标记性最有意义的抗体是
A. 抗RNP
B. 抗双链DNA
C. 抗Scl-70
D. 抗Sm
E. 抗Jo-1

正确答案：D。抗Sm

解析：系统性红斑狼疮患者血清中可查到多种自身抗体，抗双链DNA抗体、抗Sm抗体均为诊断系统性红斑狼疮中标记性抗体，但由于抗Sm抗体特异性为99%，而抗双链DNA抗体特异性为95%，因此二者相比，抗Sm抗体更具有标记意义（D对B错）。抗RNP抗体（A错）阳性率约40%，对SLE诊断特异性不高（P817）。抗Scl-70抗体（C错）多见于系统性硬化症。抗Jo-1抗体（E错）多见于多发性肌炎/皮肌炎（P801 表8-1-5抗核抗体谱常见自身抗体及临床意义）。